更换的抗菌药物品种，多久不得重新进入本机构抗菌药物供应目录
A. 10个月内
B. 11个月内
C. 12个月内
D. 13个月内
E. 14个月内

正确答案：C。12个月内

解析：清退或者更换的抗菌药物品种或者品规原则上12个月内不得重新进入本机构抗菌药物供应目录。掌握“抗菌药物临床应用概述及管理”知识点。